产后子宫复旧缩小至降入骨盆腔内的时间是
A. 产后3～4天
B. 产后7天
C. 产后10天
D. 产后21天
E. 产后42天

正确答案：C。产后10天

解析：产后10天子宫复旧已缩小至降入骨盆腔内（C对ACD错）。子宫完全恢复至未孕状态要42天（E错）。7天子宫缩小至约妊娠12周大小（B错）。